患儿，女，2岁。心前区可听到Ⅱ～Ⅲ级收缩期杂音。胸部X线显示两肺纹理减少。考虑
A. 房间隔缺损
B. 室间隔缺损
C. 动脉导管未闭
D. 法洛四联症
E. 肺动脉狭窄

正确答案：D。法洛四联症

解析：患儿心前区闻及Ⅱ-Ⅲ级收缩期杂音，提示存在肺动脉狭窄；胸片肺纹理减少提示肺血流量减少，存在右向左分流（D对）。房间隔缺损（A错）X线表现有“肺门舞蹈”征。室间隔缺损（B错）X线表现有左右心室增大的表现。动脉导管未闭（C错）X线肺门血管增粗，胸骨左缘上方有一连续性“机器”样杂音。肺动脉狭窄（E错）X线表现右心房、右心室增大。